使用明尼苏达多相人格调查表（MMPI）测查某人的人格特征，并计算各人格因子得分，这是
A. 心理评估
B. 心理测量
C. 心理测验
D. 心理诊断
E. 以上都不是

正确答案：B。心理测量